苏合香丸的功用是
A. 清热化痰，开窍定惊
B. 清热开窍，镇惊安神
C. 清热开窍，化浊解毒
D. 芳香开窍，行气止痛
E. 化痰开窍，辟秽解毒

正确答案：D。芳香开窍，行气止痛

解析：本题考查方剂的功用。苏合香丸方证因寒邪秽浊，闭阻机窍所致，功用是芳香开窍，行气温中，主治寒闭证，为温开法的代表方，又是治疗寒闭证以及心腹疼痛属于寒凝气滞证的常用方（D对）。